女，28岁。恶心、呕吐1天，诊断为急性胃炎。查体：BP120/80mmHg，心率55次/分。心电图示窦性心动过缓，该患者心动过缓的最恰当处理措施是
A. 植入临时起搏器
B. 口服阿托品
C. 植入永久起搏器
D. 静脉滴注异丙肾上腺素
E. 治疗胃炎，继续观察

正确答案：E。治疗胃炎，继续观察

解析：患者青年女性，恶心、呕吐1天，诊断为急性胃炎。心率55次/分（正常60～100次/分），成人窦性心律的频率低于60次/分称为窦性心动过缓。窦性心动过缓常见于健康的青年人、运动员与睡眠状态。其他原因包括颅内疾患、严重缺氧、低温、甲状腺功能减退、阻塞性黄疸以及应用拟胆碱药物、胺碘酮、β受体拮抗剂、非二氢吡啶类的钙通道阻滞剂或洋地黄等药物。窦房结病变和急性下壁心肌梗死亦常发生窦性心动过缓。无症状的窦性心动过缓通常无需治疗（E对）。如因心率过慢，出现心排血量不足症状，可应用阿托品（B错）或异丙肾上腺素（D错）等药物，但长期应用往往效果不确定，易发生严重副作用，故应考虑心脏起搏治疗（AB错）。由于该患者未出现心率过慢等症状，所以不需要相关治疗，只需治疗胃炎，继续观察即可。